臣药的含义是
A. 治疗主证的药
B. 治疗兼证的药
C. 治疗次兼证的药
D. 引药直达病所的药
E. 消除君药毒烈之性的药

正确答案：B。治疗兼证的药